三阳合病，腹满身重，难以转侧，口不仁面垢，谵语遗尿，若自汗出，治宜
A. 白虎汤
B. 白虎加人参汤
C. 大承气汤
D. 大柴胡汤
E. 以上均不是

正确答案：A。白虎汤

解析：阳合病，言太阳、阳明、少阳三经同时发病。然从症状表现看，实以阳明热盛为主。阳明热盛气塞，故见腹满；邪热弥漫，经气不利，故见身重，难以转侧；口为胃之外窍，阳明胃热炽盛，浊热上攻。则口不仁；足阳明经脉布于面，热浊之气熏蒸于上，故面垢；热扰神明则评语。热盛神昏，膀胱失约，则遗尿。“若自汗出者”是运用白虎汤的辨证关键。因而此证初始是“三阳合病”，而至“若自汗出”时，已经为阳明一经之病。阳明无形之热充斥，治宜白虎汤辛寒清热（A对）。若误用辛温发汗，必更伤津液，而使胃家燥热益甚，谵语加重。若误用苦寒泻下，因其里未成实，必伤伐正气，使阴液竭于下，阳气无所依附而脱于上，故见额上汗出、手足厥冷之症。